最难发生酸水解反应的苷是
A. N-苷
B. 酯苷
C. 酚苷
D. S-苷
E. C-苷

正确答案：E。C-苷

解析：本题考查的是苷的化学性质。最难发生酸水解反应的苷是C-苷（E对）。按苷键原子不同，酸水解的易难顺序为：N-苷（A错）＞O-苷＞S-苷（D错）＞C-苷。C上无未共享电子对，不能质子化，很难水解。而N碱度大，易接受质子，故最易水解。但当N原子处于嘧啶或酰胺位置时，也难于用无机酸水解。酯苷（B错）与酚苷（C错）属于O-苷，较C-苷易于水解。